下列各个选项中，哪一项是慢性牙周炎最主要的致病菌
A. 黏放线菌
B. 伴放线聚集杆菌
C. 具核梭杆菌
D. 齿垢密螺旋体
E. 牙龈卟啉单胞菌

正确答案：E。牙龈卟啉单胞菌

解析：本题考查慢性牙周炎的病因，表现诊断及预后。慢性牙周炎的主要优势致病菌为牙龈卟啉单胞菌（E对）。